可扪及搏动感的肿瘤是
A. 神经纤维瘤
B. 牙龈瘤
C. 成釉细胞瘤
D. 骨巨细胞瘤
E. 颈动脉体瘤

正确答案：E。颈动脉体瘤

解析：本题考查可扪及搏动感的肿瘤。发生于动脉血管组织的肿瘤常可扪及搏动感。颈动脉体瘤（E对）是来自化学感受器颈动脉体的肿瘤，位于颈动脉三角，扪诊可有明显的搏动感。神经纤维瘤（A错）是神经源性的肿瘤，牙龈瘤（B错）是牙龈软组织来源的肿瘤，成釉细胞瘤（C错）是牙源性上皮性肿瘤，骨巨细胞瘤（D错）是骨源性肿瘤，因此以上四种肿瘤均不能扪及搏动感。